下列病毒中不经血液传播的是
A. 乙肝
B. 丙肝
C. 戊肝
D. 丁肝
E. HIV

正确答案：C。戊肝

解析：本题考查病毒性肝炎的传播途径。戊肝（C对）主要通过粪-口途径传播，不经过血液传播。乙肝（A错）、丙肝（B错）、丁肝（D错）和HIV（E错）病毒可经过血液传播。